系统性红斑狼疮患者的典型皮肤损害为
A. 环形红斑
B. 结节性红斑
C. 面部蝶形红斑
D. 多形性红斑
E. 网状青斑

正确答案：C。面部蝶形红斑

解析：皮肤与黏膜呈蝶形分布于鼻梁和双颧颊部的红斑是SLE特征性的改变。掌握“系统性红斑狼疮”知识点。